我国目前使用的空气质量指数是采用
A. 比值简单叠加原理
B. 比值算术均数原理
C. 兼顾最高和平均分指数原理
D. 分段线性函数的原理
E. 评分加权征询原理

正确答案：D。分段线性函数的原理

解析：本题考查我国目前使用的空气质量指数原理。我国目前使用的空气质量指数是采用分段线性函数的原理（D对ABCE错），每天或者每时向社会上报告空气质量指数。